某男，30岁。发热喜凉，面红目赤，伴有口臭，牙龈肿痛，大便干燥，小便短赤，舌红，苔黄，脉数。中医辨证是
A. 实热
B. 虚热
C. 虚实错杂
D. 实寒
E. 里寒表热

正确答案：A。实热

解析：本题考查的是实热证的临床表现。发热喜凉，面红目赤，伴有口臭，牙龈肿痛，大便干燥，小便短赤，舌红，苔黄，脉数。中医辨证是该患者为实热证（A对）。实证，是指邪气过盛所反映出来的一类证候。由于实邪的性质及所在部位的不同，实证的临床表现亦极不一致。主要有：发热，腹胀痛拒按，胸闷烦躁甚至神昏谵语，呼吸喘粗，痰涎壅盛，大便秘结，小便不利，脉实有力，舌苔厚腻等。热证，多指由外感火热之邪，或因七情过激、郁而化火，或饮食不节、积蓄为热，或房事劳倦、劫夺阴精、阴虚阳亢，或阳盛阴虚，表现为机体的功能活动亢进的证候。其临床表现多见发热喜凉，口渴饮冷，面红目赤，烦躁不宁，小便短赤，大便燥结，舌红苔黄而干燥，脉数等症状。虚热（B错）证即阴虚证。阴虚证的临床表现，除见形体消瘦、口燥咽干、眩晕失眠、舌红脉细数等阴液不足的症状外，还常伴见五心烦热、潮热盗汗、舌红绛、脉数等阴不制阳、虚热内生的症状。虚实错杂（C错）：（1）实中夹虚：实中夹虚，是指以邪实为主，兼见正气虚损的病机变化。例如，外感热病发展过程中，由于邪热炽盛，消灼津液而形成的实热伤津、气阴两伤病证，出现高热、烦渴欲饮、尿少便干等表现，就属于实中夹虚的病机变化。（2）虚中夹实：虚中夹实，是指以正虚为主，兼夹邪实的病机变化。例如，脾阳不振，运化无权之水肿病，即属此类。这是由于脾失健运，气不化水，水湿停聚，泛溢肌肤所致。因为水湿之邪滞留于体内，故称之为实，但其邪实乃由脾虚不运所致，故其病变变化仍以虚为主，而邪实则居其次，属于虚中夹实的病证。实寒（D错）证即里寒证，可见剧烈腹痛、舌淡苔白、脉沉迟等。里寒表热（E错）的临床变现，2022年考试指南未明确说明。